利福平与某些药物合用时，可使后者药效减弱的原因通常
A. 酶诱导作用
B. 肾小球滤过
C. 酶抑制作用
D. 首关效应
E. 肠-肝循环

正确答案：A。酶诱导作用

解析：本题考查酶诱导作用。利福平与某些药物合用时，可使后者药效减弱的原因通常是因为酶诱导作用（A对）；利福平属于肝药酶诱导剂，与某些药物合用时，可加快后者的代谢速率，使后者药效减弱。肾小球滤过（B错）是血液中的物质流经肾小球滤过膜时选择性进入原尿；酶抑制效应（C错）是指能抑制肝药酶活性，减慢其它药物的代谢速率；首关效应（D错）是指某些药物在尚未吸收进入血循环之前被代谢，进入血循环的原形药量减少的现象；肠-肝循环（E错）是指随胆汁排入十二指肠的药物或其它代谢物，在肠道中又重新被吸收，经门静脉返回肝脏，重新进入血液循环的现象。